女，28岁，初产妇。双胎妊娠，妊娠39周临产。查体：P90次/分，BP140/80mmHg。规律宫缩10小时后宫口开全，第一胎头位娩出，新生儿体重2600g。第二胎儿为单臀先露，已衔接，胎心正常。本例恰当的处理措施是
A. 行外转胎位术
B. 产钳牵引术
C. 行内转胎位
D. 等待臀助娩
E. 立即剖宫产术

正确答案：D。等待臀助娩

解析：女，28岁，初产妇。双胎妊娠，妊娠39周临产。查体：P90次/分，BP140/80mmHg。规律宫缩10小时后宫口单臀先露（异常分娩），已衔接（处于第二产程），胎心正常。由于胎儿胎心正常，初产妇生命体征平稳，不应立即剖宫产手术（E错）。应行会阴后-侧切开术，等待臀位助娩（D对）。由于该产妇处于第二产程，所以不能行外转胎位术（AC错）。产钳牵引术（B错）对胎儿损伤大而不用。